急性胃炎的临床表现不包括
A. 黄疸
B. 食欲减退
C. 呕吐
D. 上腹痛
E. 恶心

正确答案：A。黄疸